下列哪一项可不必放置引流物
A. 创口渗液多
B. 无菌创口
C. 留有无效腔的创口
D. 术中止血不彻底的创口
E. 凝血功能低下的患者

正确答案：B。无菌创口

解析：无菌创口，特别是单纯整复手术，一般不放置引流。对术中止血不彻底和凝血功能低下的患者，为防止血肿形成，也应放置引流。掌握“口外手术打结、缝合及外科引流”知识点。